四环素牙外脱色法一疗程共
A. 1～2次
B. 2～4次
C. 5～8次
D. 6～10次
E. 10～12次

正确答案：C。5～8次

解析：本题考查四环素牙外脱色法。四环素牙外脱色法一疗程共5～8次（C对）。外脱色法：清洁牙面，用凡士林涂龈缘：将浸过30%过氧化氢液的吸药纸片贴敷于前牙唇面，与龈缘应留有少许距离；红外线或白炽灯照射10分钟；一疗程共5～8次。